下列药品宜冷处贮存但不应冷冻的是
A. 氯化钾注射液
B. 双歧三联活菌制剂
C. 卡前列甲酯栓剂
D. 甘露醇注射液
E. 葡萄糖注射液

正确答案：B。双歧三联活菌制剂

解析：本题考查药品的贮存。双歧三联活菌制剂（B错，为本题正确答案）为活菌制剂，冷冻可导致药物失活无效，冷处贮存即可。氯化钾（A对）、葡萄糖（D对）、甘露醇（E对）等注射液冷冻不影响药物药效。卡前列甲酯栓剂（C对）应于低于-5℃保存。